男性，52岁。咳嗽，咳痰5年，肺功能测定为阻塞性通气障碍，下列哪项是错的
A. 残气容积占肺总量的百分比降低
B. 最大呼气中期流速减低
C. 肺活量减低
D. 残气量增加
E. 第一秒用力呼气量减低

正确答案：A。残气容积占肺总量的百分比降低

解析：肺功能检查是判断气流受限的主要客观指标，对COPD诊断、严重程度评价、疾病进展、预后及治疗反应等有重要意义。阻塞性通气障碍残气容积占肺总量的百分比应增高（A错，为本题正确答案）。最大呼气中期流速减低、第一秒用力呼气量减低是阻塞性通气障碍的表现（BE对）。肺活量减低、残气量增加表面肺过度充气，有参考价值（CD对）。